根据《反不正当竞争法》，下列互联网药品信息服务提供者的行为中，属于互联网不正当竞争行为的是
A. 转载药品监督管理部门或药品生产企业发布的药品召回信息
B. 转载国家药品监督管理部门发布的药品管理规范性文件
C. 利用技术手段，对其他合法药品经营者的网络服务实施不兼容
D. 对非法售药网站实施屏蔽

正确答案：C。利用技术手段，对其他合法药品经营者的网络服务实施不兼容

解析：本题考查互联网不正当竞争行为。根据《反不正当竞争法》，下列互联网药品信息服务提供者的行为中，属于互联网不正当竞争行为的是利用技术手段，对其他合法药品经营者的网络服务实施不兼容（C对）。互联网不正当竞争行为：经营者利用网络从事生产经营活动，应当遵守反不正当竞争法的各项规定。同时，经营者不得利用技术手段，通过影响用户选择或者其他方式，实施下列妨碍、破坏其他经营者合法提供的网络产品或者服务正常运行的行为：①未经其他经营者同意，在其合法提供的网络产品或者服务中，插入链接、强制进行目标跳转；②误导、欺骗、强迫用户修改、关闭、卸载其他经营者合法提供的网络产品或者服务；③恶意对其他经营者合法提供的网络产品或者服务实施不兼容；④其他妨碍、破坏其他经营者合法提供的网络产品或者服务正常运行的行为。